不能与五灵脂同用的药是
A. 川乌
B. 人参
C. 甘遂
D. 半夏
E. 海藻

正确答案：B。人参

解析：本题考查的是人参的使用注意。不能与五灵脂同用的药是人参（B对）。人参：【使用注意】为保证人参的补气药效，服用人参时不宜饮茶水和吃白萝卜。因属补虚之品，邪实而正不虚者忌服。反藜芦，畏五灵脂，恶莱菔子、皂荚，均忌同用。川乌（A错）：【使用注意】本品性热有毒，故孕妇忌服，不宜过量或久服。反半夏、全瓜蒌、瓜蒌子、瓜蒌皮、天花粉、川贝母、浙贝母、白蔹、白及，畏犀角，均不宜同用。酒浸毒性强，故不宜浸酒饮用。甘遂（C错）：【使用注意】本品峻泻有毒，故孕妇及虚寒阴水者忌服，体弱者慎服，不可连续或过量服用。对消化道有较强的刺激性，服后易出现恶心呕吐、腹痛等副作用，用枣汤送服或研末装胶囊吞服，可减轻反应。反甘草，不宜与甘草同用。半夏（D错）：【使用注意】本品温燥，故阴虚燥咳、出血证忌服，热痰慎服。生品毒大，一般不作内服。反乌头，不宜与附子、川乌、制川乌、草乌、制草乌同用。海藻（E错）：【使用注意】反甘草。